肘横纹平肘尖至腕掌背侧横纹的骨度分寸是
A. 12寸
B. 13寸
C. 6寸
D. 8寸
E. 9寸

正确答案：A。12寸

解析：根据骨度分寸量表，肘横纹平肘尖至腕掌背侧横纹的骨度分寸是12寸（A对）。